以下关于牙体外形与牙附着方式联系的说法错误的是
A. 硬骨鱼类的牙齿属于同形牙，为端生牙
B. 两栖类动物的牙齿属于端生牙，为单椎体同形牙
C. 哺乳类动物的牙齿属于异形牙，其牙齿位于牙槽窝内，属槽生牙
D. 爬行动物牙齿为侧生牙，形态为单椎体同形牙
E. 爬行动物的牙齿为端生牙，形态为单椎体同形牙

正确答案：E。爬行动物的牙齿为端生牙，形态为单椎体同形牙

解析：同形牙：全口牙的形态相同，多为三角片或单椎体形，大小相似，如鱼类的牙齿。异形牙：牙体形态各异，大小不一，可分为切牙、尖牙、前磨牙和磨牙四类，如哺乳动物包括人类的牙。端生牙：此类牙无牙根，仅借纤维膜附着于颌骨的边缘，易脱落。大部分硬骨鱼类为端生牙。侧生牙：除牙的基部与颌骨相连外，其一侧也附着于颌骨的内缘，此类牙虽无完善的牙根，但比端生牙牢固，如爬行类动物的牙。槽生牙：此类牙有较完善的位于牙槽窝内的牙根，并有血管和神经末梢从根尖孔进入髓腔。哺乳动物包括人类的牙均为槽生牙。掌握“牙的演化”知识点。